慢性化脓性颌骨骨髓炎的病理诊断依据是
A. 牙槽黏膜红肿
B. 大量炎细胞浸润
C. 病理性骨折
D. 死骨形成
E. 瘘管形成

正确答案：D。死骨形成

解析：慢性化脓性骨髓炎主要病理表现为伴有明显的骨吸收和死骨形成的化脓性病灶。掌握“急慢性化脓性颌骨骨髓炎”知识点。